下列哪项不属于现况调查的目的
A. 了解某种疾病或健康状况在特定时间、地区及人群中的分布
B. 了解人群的某些特征与疾病或健康状态之间的联系，以逐步建立病因假设
C. 考核防治措施的效果
D. 了解人群的健康水平，找出防疫和保健应该开展的工作
E. 计算危险因素的相对危险度

正确答案：E。计算危险因素的相对危险度

解析：本题考查现况调查的目的。现况调查的目的包括：①了解某种疾病或健康状况在特定时间、地区及人群中的分布（A对）；②了解人群的某些特征与疾病或健康状态之间的联系，以逐步建立病因假设（B对）；③考核防治措施的效果（C对）；④了解人群的健康水平，找出防疫和保健应该开展的工作（D对）。计算危险因素的相对危险度（E错，为本题正确答案）属于队列研究的内容。